可以开展社区卫生服务的主体有
A. 个体诊所
B. 街道医院
C. 民营医院
D. 三级医院
E. 以上都是

正确答案：E。以上都是

解析：本题考查社区卫生服务的主体。可以开展社区卫生服务的主体包括：个体诊所、街道医院、民营医院、三级医院等。本题中以上选项均是（E对ABCD错）社区卫生服务的主体。